在成型或分装前使用同一台混合设备一次混合量所生产的均质产品为一批的属于
A. 大容量注射剂
B. 粉针剂
C. 固体制剂
D. 液体制剂
E. 冻干粉针剂

正确答案：C。固体制剂